与活动有关的血尿和腰腹疼痛，首先应考虑的是
A. 急性阑尾炎
B. 急性肾盂肾炎
C. 上尿路结石
D. 卵巢囊肿扭转
E. 膀胱癌

正确答案：C。上尿路结石

解析：与活动有关的血尿和腰腹疼痛，是上尿路结石的典型症状，因此出现上述症状时首先应考虑的是上尿路结石（C对）。急性阑尾炎（A错）典型症状是转移性右下腹痛，无血尿。急性肾盂肾炎（B错）主要表现为发热、腰痛、膀胱刺激症状，腰痛与活动不相关。卵巢囊肿蒂扭转（D错）主要表现为突发的下腹剧烈疼痛，伴恶心、呕吐甚至休克。膀胱癌（E错）多表现为间歇性肉眼血尿，血尿与活动无关。